不属于静脉畸形临床特点的是
A. 旧分类称海绵状血管瘤
B. 如果位置较深，皮肤或黏膜颜色正常
C. 扪之柔软，可以被压缩
D. 有时可扪到静脉石
E. 移动试验阴性

正确答案：E。移动试验阴性

解析：本题考查血管瘤与脉管畸形。静脉畸形旧分类称海绵状血管瘤（A对）。静脉畸形好发于颊、颈、眼睑、唇、舌或口底部。位置深浅不一，如果位置较深，则皮肤或黏膜颜色正常（B对）；表浅病损则呈现蓝色或紫色。边界不太清楚，扪之柔软，可以被压缩（C对），有时可扪到静脉石（D对）。当头低位时；病损区则充血膨大；恢复正常位置后，肿胀亦随之缩小，恢复原状，此称为体位移动试验阳性（E错，为本题正确答案）。